可阻滞钠通道，用于治疗室性心律失常的药品是
A. 硝酸甘油
B. 利多卡因
C. 氨氯地平
D. 氯沙坦
E. 美托洛尔

正确答案：B。利多卡因

解析：本题考查利多卡因。利多卡因（B对）为抗心律失常药，属于钠通道阻滞剂，仅用于室性心律失常。硝酸甘油（A错）为硝酸酯类抗心绞痛药。氨氯地平（C错）为钙通道阻滞剂，用于高血压，稳定性心绞痛和变异型心绞痛。氯沙坦（D错）为血管紧张素Ⅱ受体阻断剂，能够降低血压。美托洛尔（E错）为β₁受体阻断剂，主要用于室上性和室性心律失常。